一位患者表现交叉性舌下神经瘫痪。右侧舌萎缩，伸舌时偏向右侧。此外，病人出现左半身上运动神经元瘫痪。引起舌下神经交叉性瘫痪和左半身上运动神经元瘫痪的病变肯定位于
A. 延髓上部的内侧部
B. 延髓下部的后外侧部
C. 脑桥下部的内侧部
D. 脑桥中部的后外侧部
E. 中脑的下部

正确答案：A。延髓上部的内侧部

解析：交叉性舌下神经瘫痪和左半身上运动神经元瘫痪均是由于患者右侧锥体束损伤引起的，因为锥体束经过延髓上部的内侧部下行，下行至脊髓的纤维束称皮质脊髓束 ; 止于脑干内一般躯体和特殊内脏运动核的纤维束称皮质核束，所以病变一定位于延髓上部的内侧部（A对）。